下列哪些药物可用于抗结核病
A. 异烟肼
B. 呋喃妥因
C. 乙胺丁醇
D. 克霉唑
E. 甲硝唑

正确答案：A、C。异烟肼；乙胺丁醇

解析：本题考查抗结核药。用于抗结核病的药物有异烟肼（A对）、乙胺丁醇（C对）。第一线抗结核病药：包括异烟肼、利福平、乙胺丁醇、吡嗪酰胺、链霉素等为常用抗结核病药，临床疗效好、不良反应少。第二线抗结核病药：包括对氨基水杨酸、卡那霉素、乙硫异烟胺、丙硫异烟胺、卷曲霉素、利福喷丁、司帕沙星等，抗菌作用较弱、毒性较大或临床验证不足，主要作为结核分枝杆菌对第一线药物产生耐药性或患者不能耐受第一线药物时的备选药物。呋喃妥因（B错）为合成抗菌药物。克霉唑（D错）为咪唑类抗真菌药。甲硝唑（E错）为硝基咪唑类抗生素。